为研究雄黄矿附近地区人群慢性砷中毒的患病率及其分布特点，在雄黄矿排放洗矿水河流下游的3个村庄进行调查，每个村子各选取在当地居住5年以上，无职业性砷接触史的居民约200人，进行体检并填写健康调查问卷。此种研究属于
A. 病例对照研究
B. 现况研究
C. 生态学研究
D. 社区试验
E. 队列研究

正确答案：B。现况研究